下列哪项对诊断肺炎球菌性肺炎最有意义
A. 白细胞总数及中性粒细胞数增高
B. 胸痛咯血色痰
C. 肺部实变体征
D. X线示肺部片状阴影，呈肺叶或肺段分布
E. 肺部闻及湿罗音

正确答案：D。X线示肺部片状阴影，呈肺叶或肺段分布

解析：肺炎球菌肺炎的早期仅见肺纹理增粗或受累的肺段、肺叶稍模糊，逐渐随病情进展可出现大片炎症浸润阴影或实变影，并沿大叶、肺段或亚肺段分布，实变阴影中可见支气管充气征，故X线示肺部片状阴影，呈肺叶或肺段分布（D对），具有特异性，为诊断肺炎球菌性肺炎最有意义的检查。白细胞总数及中性粒细胞数增高（A错）提示细菌感染，胸痛咯血色痰（B错）提示肺部出血，肺部实变体征（C错）提示肺部炎症改变，肺部闻及湿罗音（E错）其他类型的肺炎也可见，以上这些并无特异性，故不能作出肺炎球菌性肺炎的诊断。